抑制肝药酶的药物是
A. 氯化钙
B. 苯巴比妥
C. 布洛芬
D. 洋地黄毒苷
E. 别嘌呤醇

正确答案：E。别嘌呤醇